hCG妊娠期间分泌量达高峰的时间是
A. 妊娠4～6周
B. 妊娠8～10周
C. 妊娠12～14周
D. 妊娠16～18周
E. 妊娠20～22周

正确答案：B。妊娠8～10周

解析：HCG妊娠期间分泌量达高峰的时间是妊娠8～10周（B对），持续约19日迅速下降，直至妊娠前。